5岁患儿，8月15日开始发热，伴头痛恶心呕吐一次，次日稀便三次，精神不振，抽搐一次。体检：急性热病容，嗜睡状，颈强（+），克氏征（++），血常规检查：WBC15.0×10⁹/L，脑脊液为无色透明，白细胞数100×10⁶/L，中性80%。该患者最可能的诊断是
A. 中毒性菌痢
B. 流行性脑脊髓膜炎（脑膜脑炎型）
C. 结核性脑膜炎
D. 流行性乙型脑炎
E. 化脓性脑膜炎

正确答案：D。流行性乙型脑炎

解析：最可能的诊断是流行性乙型脑炎的原因是：首先，患儿出现高热、抽搐、颈项强直、克氏征阳性，符合上述流行性乙型脑炎（D对）的临床特征。其次，患儿8月15日发病，也符合流行性乙型脑炎80%-90%的病例集中在7、8、9三个月的表现。中毒性菌痢（A错）起病较流行性乙型脑炎更急，常于24小时内出现高热、抽搐、昏迷和感染性休克，一般无脑膜刺激征。做肛拭子或生理盐水灌肠镜检粪便，可见大量脓、白细胞，而患儿出现的症状与之不符。流行性脑脊髓膜炎（B错）（脑膜脑炎型）在典型的脑膜炎期，压力增高，外观呈浑浊米汤样甚或脓样，但患儿脑脊液为无色透明，故不诊断流行性脑脊髓膜炎。结核性脑膜炎（C错）多有结核病史或密切接触史，起病缓慢，病程较长，有低热、盗汗、消瘦等症状，神经系统症状出现较晚，无瘀点、瘀斑，脑脊液以单核细胞为主，蛋白质增加，糖和氯化物减少，脑脊液涂片可检查抗酸染色阳性杆菌，而患儿出现的症状与之不符。化脓性脑膜炎（E错）脑脊液呈细菌性脑膜炎改变，涂片和培养可找到细菌，而患儿的脑脊液检查结果为病毒性脑膜炎。